感染性腹泻的传播途径不包括
A. 生活接触
B. 经水传播
C. 食物型传播
D. 苍蝇
E. 垂直传播

正确答案：E。垂直传播